须先用地塞米松及组胺H₂和H₂受体阻断药预防过敏反应的药物是
A. 阿霉素
B. 放线菌素D
C. 环磷酰胺
D. 丝裂霉素
E. 紫杉醇

正确答案：E。紫杉醇

解析：本题考查抗肿瘤药。紫杉醇（E对）为抑制蛋白质合成与功能药物，治疗前须先用地塞米松及组胺H₂和H₂受体阻断药预防过敏反应。阿霉素（A错）又叫多柔比星，为干扰转录过程和阻止RNA合成的药物，抗瘤谱广。放线菌素D（B错）为细胞周期非特异性药物，与放射治疗合用，提高肿瘤对放射治疗的敏感性。环磷酰胺（C错）为直接影响DNA结构和功能的药物，抗瘤谱广。丝裂霉素（D错）为破坏DNA的抗生素，主要用于治疗胃癌、结肠直肠癌、肺癌、胰腺癌。